可造成食品生物性污染的事件是
A. 奶粉中加入三聚氰胺
B. 火鸡食用含发霉花生的饲料
C. 苹果表面农药残留
D. 鱼虾遭受镉污染
E. 果汁中添加过量色素

正确答案：B。火鸡食用含发霉花生的饲料

解析：本题考查食品生物性污染。食品的生物性污染包括微生物、寄生虫和昆虫的污染。可造成食品生物性污染的事件是火鸡食用含发霉花生的饲料（B对）。奶粉中加入三聚氰胺（A错）、苹果表面农药残留（C错）、鱼虾遭受镉污染（D错）、果汁中添加过量色素（E错）属于食品化学性污染。